功能疏散风热、透疹止痒、息风止痉的药物是
A. 菊花
B. 桑叶
C. 蝉蜕
D. 牛蒡子
E. 薄荷

正确答案：C。蝉蜕

解析：本题考查的是蝉蜕的功效。功能疏散风热、透疹止痒、息风止痉的药物是蝉蜕（C对）。蝉蜕：【功效】疏散风热，透疹止痒，明目退翳，息风止痉。菊花（A错）：【功效】疏散风热，平肝明目，清热解毒。桑叶（B错）：【功效】疏散风热，清肺润燥，平肝明目，凉血止血。牛蒡子（D错）：【功效】疏散风热，宣肺利咽，解毒透疹，消肿疗疮。薄荷（E错）：【功效】宣散风热，清利头目，利咽，透疹，疏肝。